霍乱治疗的关键是
A. 有效的抗菌治疗
B. 及时足量补液
C. 清除霍乱肠毒素
D. 透析治疗
E. 补钾治疗

正确答案：B。及时足量补液

解析：补充液体和电解质是治疗霍乱的关键（B对）。口服补液能代替静脉补液或减少静脉补液量，减少医源性电解质紊乱及静脉输液的不良反应，这对心肺功能不良、年老体弱以及需要及时补钾的患者尤为重要。轻度脱水者以口服补液为主，中、重度脱水患者或呕吐剧烈不能口服补液者进行静脉补液，待病情稳定、呕吐停止、脱水程度减轻后尽快开始口服补液。